痰热内郁癫痫发狂可用
A. 铅丹
B. 硼砂
C. 明矾
D. 硫黄
E. 炉甘石

正确答案：C。明矾

解析：本题考查的是白矾的主治病证。痰热内郁癫痫发狂可用明矾（C对）。明矾为白矾的别名。【主治病证】（1）疮疡，疥癣，湿疹瘙痒，阴痒带下。（2）吐衄下血，泻痢不止。（3）风痰痫病，痰热癫狂。（4）湿热黄疸。铅丹（A错）：【主治病证】（1）疮疡溃烂，黄水湿疮。（2）惊痫癫狂。（3）疟疾。硼砂（B错）：【主治病证】（1）咽喉肿痛，口舌生疮，目赤翳障。（2）肺热痰咳。硫黄（D错）：【主治病证】（1）疥癣，湿疹，秃疮，阴疽恶疮。（2）肾阳不足之阳痿、小便频数，肾虚喘促。（3）虚冷便秘。炉甘石（E错）：【主治病证】（1）目赤翳障，烂弦风眼。（2）疮疡溃烂不敛，湿疹湿疮。